小儿肺炎的病因分类中，不包括
A. 病毒性肺炎
B. 细菌性肺炎
C. 衣原体肺炎
D. 嗜酸性粒细胞性肺炎
E. 间质性肺炎

正确答案：E。间质性肺炎

解析：病毒性肺炎（A对）、细菌性肺炎（B对）、衣原体肺炎（C对）、嗜酸性粒细胞性肺炎（D对）都属于小儿肺炎的病因分类。间质性肺炎不属于病因分类（E错，为本题正确答案），属于病理分类。